根据《麻醉药品和精神药品管理条例》，具有销售第二类精神药品资格的零售企业
A. 应当凭执业助理医师出具的处方，按规定剂量销售第二类精神药品
B. 应当凭执业医师出具的处方，按规定剂量销售第二类精神药品
C. 应当凭执业药师出具的处方，按医嘱剂量销售第二类精神药品
D. 应当凭医师出具的处方，按医嘱剂量销售第二类精神药品
E. 应当凭执业药师出具的处方，按医嘱剂量销售第二类精神药品

正确答案：B。应当凭执业医师出具的处方，按规定剂量销售第二类精神药品

解析：本题考查麻醉药品和精神药品零售规定。根据《麻醉药品和精神药品管理条例》，具有销售第二类精神药品资格的零售企业应当凭执业医师出具的处方，按规定剂量销售第二类精神药品（B对）。麻醉药品和精神药品零售规定：1.麻醉药品和第一类精神药品不得零售。除经批准的药品零售连锁企业外，其他药品零售企业不得从事第二类精神药品零售活动。2.第二类精神药品零售企业应当凭执业医师开具的处方，按规定剂量销售第二类精神药品，并将处方保存2年备查。零售第二类精神药品时，处方应经执业药师或其他依法经过资格认定的药学技术人员复核；第二类精神药品一般每张处方不得超过7日常用量，禁止超剂量或者无处方销售第二类精神药品。3.第二类精神药品零售企业不得向未成年人销售第二类精神药品。在难以确定购药者是否为未成年人的情况下，可查验购药者身份证明。4.罂粟壳，必须凭盖有乡镇卫生院以上医疗机构公章的医生处方配方使用，不准生用，严禁单味零售，处方保存3年备查。